嘌呤碱基的C8来自于
A. N₅‒CH‒NH‒FH₄
B. N₅‒CH₃‒FH₄
C. N₁₀‒CHO‒FH₄
D. N₅，N₁₀‒CH₂‒FH₄
E. N₅，N₁₀＝CH‒FH₄

正确答案：E。N₅，N₁₀＝CH‒FH₄